滴虫阴道炎最常见的传播途径是
A. 性直接接触感染
B. 经血循环感染
C. 间接接触感染
D. 内源性感染
E. 经淋巴循环感染

正确答案：A。性直接接触感染

解析：滴虫阴道炎最常见的传播途径是性直接接触感染（A对），间接接触感染（C错）较少见。血循环感染（B错）、内源性感染（D错）及经淋巴循环感染（E错）不是滴虫性阴道炎的传播方式。内源性感染为外阴阴道假丝酵母菌病的主要传播途径。